患者，男，52岁，BMI28kg/m²，既往有动脉粥样硬化性心血管病、高尿酸血症、痛风病。患者诉昨晚8点起右大脚趾关节处疼痛难忍，宜使用的药物是
A. 非布司他
B. 碳酸氢钠
C. 别嘌醇
D. 秋水仙碱
E. 苯溴马隆

正确答案：D。秋水仙碱

解析：本题考查秋水仙碱。患者，男，52岁，BMI28kg/m²，既往有动脉粥样硬化性心血管病、高尿酸血症、痛风病。患者诉昨晚8点起右大脚趾关节处疼痛难忍，宜使用的药物是秋水仙碱（D对）。急性痛风发作主要用秋水仙碱和NSAID，慢性痛风发作主要用丙磺舒和别嘌醇（C错）等。非布司他（A错）适用于痛风患者高尿酸血症的长期治疗。不推荐用于无临床症状的高尿酸血症。碳酸氢钠（B错）是碱化尿液药，临床上往往将碳酸氢钠结合苯溴马隆等促进尿酸排出的药物合用，提高降尿酸的效果。苯溴马隆（E错）适用于原发性和继发性高尿酸血症、各种原因引起的痛风以及痛风性关节炎非急性发作期。